治疗中风痰迷，心肝有热，应选用的药物是
A. 天南星
B. 石菖蒲
C. 竹沥
D. 冰片
E. 牛黄

正确答案：E。牛黄

解析：牛黄味苦性寒凉，入心肝经，既能清心凉肝，又能豁痰开窍而苏醒神志，可治疗中风痰迷，心肝有热（E对）。天南星的功效为燥湿化痰，祛风止痉，散结消肿。治疗顽痰咳喘，胸膈胀闷；风痰眩晕，中风痰壅，口眼㖞斜，半身不遂，癫痫，惊风，破伤风；痈肿，瘰疬痰核，蛇虫咬伤（A错）。石菖蒲的功效为开窍豁痰，醒神益智，化湿和胃。治疗痰蒙清窍，神昏癫痫；健忘失眠，耳鸣耳聋；湿阻中焦，脘痞不饥，噤口下痢（B错）。竹沥的功效为清热豁痰，定惊利窍。治疗痰热咳喘；中风痰迷，惊痫癫狂（C错）。冰片的功效为开窍醒神，清热止痛。治疗热病神昏，惊厥，中风痰厥，气郁暴厥，中恶昏迷；胸痹心痛；目赤肿痛，口舌生疮，咽喉肿痛，耳道流脓；疮疡肿痛，久溃不敛，烧烫伤（D错）。